老年心力衰竭患者症状加重的最常见诱因是
A. 过度劳累
B. 摄入液体过多
C. 心肌缺血
D. 室性期前收缩
E. 呼吸道感染

正确答案：E。呼吸道感染

解析：有基础疾病的患者，其心力衰竭症状往往由一些增加心脏负荷的因素所诱发。老年患者多伴有心肺疾病，呼吸道感染（E对）是老年心力衰竭患者症状加重的最常见诱因。过度劳累（A错）、摄入液体过多（B错）、心肌缺血（C错）及室性期前收缩（D错）均是加重心衰的诱因，但并非最常见诱因。